越鞠丸的功用是
A. 行气和血
B. 行气消痞
C. 行气散结
D. 行气解郁
E. 行气止痛

正确答案：D。行气解郁

解析：越鞠丸中香附行气解郁以治气郁。川芎为血中之气药，功善行气活血，以解血郁；苍术燥湿运脾，以解湿郁；栀子清热泻火，以解火郁；神曲消食和胃，以解食郁，四药皆为臣佐之品。诸药合用，行气解郁（D对），气行血活，湿祛热清，食化脾健，气、血、湿、火、食五郁自解。至于痰郁，或因气滞湿聚而生，或因饮食积滞而致，或因火邪炼液而成，五郁得解，则痰郁自消。